卫生服务综合评价内容的主要特征是
A. 重要性、实用性、足够程度、进度、效率、影响
B. 适宜程度、足够程度、实用性、进度、效率、影响
C. 适宜程度、足够程度、进度、效率、效果、影响
D. 适宜程度、足够程度、实用性、进度、效率、效果

正确答案：C。适宜程度、足够程度、进度、效率、效果、影响

解析：本题考查卫生服务综合评价内容的主要特征。卫生服务综合评价内容的主要特征是：适宜程度、足够程度、进度、效率、效果、影响（C对ABD错）。